以下选项中蛋白尿少见于：
A. 急性肾小球肾炎
B. 慢性肾小球肾炎
C. 原发性肾病综合征
D. 慢性肾衰竭早期
E. 急性肾盂肾炎

正确答案：E。急性肾盂肾炎

解析：急性肾小球肾炎（A对）、慢性肾小球肾炎（B对）都有血尿、蛋白尿、水肿、高血压症状。原发性肾病综合征（C对）一般有大量蛋白尿、低白蛋白血症、水肿、高脂血症等症状。慢性肾衰竭早期（D对）一般可有水电解质紊乱、蛋白尿等各系统症状。急性肾盂肾炎（E错，为本题正确答案）一般无蛋白尿症状。